舌癌区域性淋巴结转移早的原因
A. 生长快
B. 舌淋巴丰富
C. 距区域淋巴结近
D. 舌机械活动频繁
E. 舌淋巴及血运丰富，舌活动频繁

正确答案：E。舌淋巴及血运丰富，舌活动频繁

解析：舌常发生早期颈淋巴结转移，且转移率较高，因舌体具有丰富的淋巴管和血液循环，加以舌的机械运动频繁，这些均为促进舌癌转移的因素。掌握“鳞状细胞癌概述及舌癌、牙龈癌”知识点。